患者，男，48岁。近日腹痛便秘，胁下偏痛，发热，手足厥逆，舌苔白腻，脉弦紧。治疗应首选
A. 大黄附子汤
B. 济川煎
C. 麻子仁丸
D. 温脾汤
E. 木香槟榔丸

正确答案：A。大黄附子汤

解析：患者近日腹痛便秘，可知体内有积滞；胁下偏痛，发热，是积滞阻遏气机，郁而发热；手足厥逆，舌苔白腻，脉弦紧可知机体阳气不能运化四肢，故其为寒结内实的病证，宜用大黄附子汤温里散寒，通便止痛（A对）。济川煎（B错）的功用为温肾益精，润肠通便。主治：肾虚便秘。麻子仁丸（C错）的功用是润肠泄热，行气通便。主治：脾约证。温脾汤（D错）的功用为攻下冷积，温补脾阳。主治：阳虚冷积证。木香槟榔丸（E错）的功用为行气导滞，攻积泄热。主治：痢疾，食积。